大脑前动脉主要供应
A. 大脑前面
B. 大脑背外侧面
C. 大脑内侧面
D. 大脑底面
E. 大脑后部

正确答案：C。大脑内侧面

解析：大脑前动脉皮质支主要供应顶枕沟以前的半球内侧面（C对）、额叶底面的一部分和额、顶两叶上外侧面的上部。